含牙周膜穿通纤维的牙骨质是
A. 1.无细胞无纤维牙骨质
B. 有细胞固有纤维牙骨质
C. 无细胞固有纤维牙骨质
D. 有细胞混合性分层牙骨质
E. 无细胞外源性纤维牙骨质

正确答案：E。无细胞外源性纤维牙骨质

解析：无细胞外源性纤维牙骨质即含牙周膜穿通纤维的牙骨质。掌握“牙骨质”知识点。